慢性排斥反应中，移植物的血管病变特点是
A. 血管内膜纤维化
B. 血管肌层肥厚
C. 血管外膜纤维组织增生
D. 血管壁纤维性坏死
E. 血管壁玻璃样变性

正确答案：A。血管内膜纤维化

解析：慢性排斥反应多发生在术后几个月至1年以后，其基本病变是小动脉内膜纤维化（A对）。血管肌层肥厚（B错）是高血压肌型小动脉的病变特点。血管外膜纤维组织增生（C错）是系统性红斑狼疮累及脾动脉时的病变特点（P246）。血管壁纤维性坏死（D错）是超急性排斥反应、风湿病、结节性多动脉炎、新月体性肾小球肾炎、急进型高血压等多种变态反应性疾病（P21）的病变特点。血管壁玻璃样变性（E错）是良性高血压细小动脉硬化的基本病变（P140）。